称为黏肽的是
A. 核质
B. 中介体
C. 肽聚糖
D. 核糖体
E. 异染颗粒

正确答案：C。肽聚糖

解析：肽聚糖或称作黏肽，为细胞壁的主要成分。掌握“细菌的大小、形态和基本结构”知识点。